关于药品注册类别管理要求的说法，错误的是
A. 中药注册按照中药创新药、中药改良型新药、中药同名同方仿制药等进行分类
B. 药品注册按照中药、化学药和生物制品等进行分类注册管理
C. 境外生产药品的注册申请，按照药品的细化分类和相应的申报资料要求执行
D. 化学药注册按照化学药创新药、化学药改良型新药、仿制药等进行分类

正确答案：A。中药注册按照中药创新药、中药改良型新药、中药同名同方仿制药等进行分类

解析：本题考查的是药品注册类别。关于药品注册类别管理要求的说法，错误的是中药注册按照中药创新药、中药改良型新药、中药同名同方仿制药等进行分类（A错，为本题正确答案）。药品注册，按照中药、化学药和生物制品等进行分类注册管理（B对）。中药注册按照中药创新药、中药改良型新药、古代经典名方中药复方制剂、同名同方药等进行分类。化学药注册按照化学药创新药、化学药改良型新药、仿制药等进行分类（D对）。生物制品注册按照生物制品创新药、生物制品改良型新药、已上市生物制品（含生物类似药）等进行分类。中药、化学药和生物制品等药品的细化分类和相应的申报资料要求，由国家药品监督管理局根据注册药品的产品特性、创新程度和审评管理需要组织制定，并向社会公布。境外生产药品的注册申请，按照药品的细化分类和相应的申报资料要求执行（C对）。